（109～111题共用题干）男婴，4个月。反复发作性吸入性呼吸困难伴吸气时喉鸣，口唇青紫3次。无发热。发作期间一般情况良好。枕部指压有乒乓球样感，肺、心未见异常。首选的检查是
A. 咽拭子培养
B. 胸片X线片
C. 喉镜
D. 血电解质
E. 血气分析

正确答案：D。血电解质

解析：患者男婴，4个月（维生素D缺乏性手足抽搐症的好发人群）。反复发作性吸入性呼吸困难伴吸气时喉鸣，口唇青紫3次（临床反复出现呼吸困难、缺氧表现，提示存在维生素D缺乏性手足抽搐可能）。无发热（排除高热惊厥可能）。发作期间一般情况良好。枕部指压有乒乓球样感（维生素D缺乏性佝偻病的典型体征），肺、心未见异常（排除呼吸循环系统病变导致的呼吸困难）。结合以上临床表现及体格检查，该患儿最有可能是维生素D缺乏性手足抽搐症。维生素D缺乏性手足抽搐征的诊断要点为手足抽搐的临床表现和血钙降低，查血电解质（D对）能准确得出血钙浓度。咽拭子（A错）主要用于呼吸道感染的实验室检查；胸片X线（B错）主要用于心肺疾病的检查；喉镜（C错）用于诊断喉部疾病；血气分析（E错）是用于判断机体是否存在酸碱平衡失调以及缺氧的检验手段，以上一般都不用于诊断维生素D缺乏性手足抽搐征。